甲是药品上市许可持有人，依法持有甲钴胺片等药品品种；乙是药品生产企业，生产范围：片剂，胶囊剂；丙是药品生产企业，生产范围：胶囊剂，颗粒剂；丁是全国性药品批发企业，经营范围：麻醉药品、中成药、中药饮片、化学药、生物制品，具备药品现代物流条件；戊是县级区域性药品批发企业，经营范围：中成药、化学药；己是药品零售连锁企业所属门店，经营类别：处方药、甲类非处方药，乙类非处方药，经营范围：第二类精神药品、中成药、中药饮片，化学药。根据药品监督管理法规，结合题目提供的信息，关于委托销售与委托储存、运输行为的说法，正确的
A. 甲可以委托戊销售，戊再委托丁储存运输甲钴胺片
B. 甲可以委托乙生产，同时委托乙销售甲钴胺片
C. 甲可以委托丁销售，丁再委托戊销售甲钴胺片
D. 甲可以委托丁销售，同时委托戊在所在地储存运输甲钴胺片

正确答案：A。甲可以委托戊销售，戊再委托丁储存运输甲钴胺片

解析：本题考查药品委托销售与委托储存、运输管理。甲是药品上市许可持有人，依法持有甲钴胺片等药品品种；丁是全国性药品批发企业，经营范围：麻醉药品、中成药、中药饮片、化学药、生物制品，具备药品现代物流条件；戊是县级区域性药品批发企业，经营范围：中成药、化学药。根据药品监督管理法规，结合题目提供的信息，关于委托销售与委托储存、运输行为的说法，正确的甲可以委托戊销售，戊再委托丁储存运输甲钴胺片（A对）。药品上市许可持有人自行销售药品的，应当具备本法第五十二条规定的条件；委托销售的，应当委托符合条件的药品经营企业（B错）。药品上市许可持有人自行生产药品的，应当依照本法规定取得药品生产许可证；委托生产的，应当委托符合条件的药品生产企业。